下列疾病中，骨髓有核红细胞出现“核老浆幼”现象的是
A. 巨幼红细胞性贫血
B. 急性红血病
C. 缺铁性贫血
D. 骨髄增生异常综合症
E. 再障

正确答案：C。缺铁性贫血

解析：“核老浆幼”是指红细胞核浆发育不同步，胞浆发育滞后于胞核，通常见于缺铁性贫血。缺铁性贫血（C对）时，由于原料铁缺乏或铁利用障碍导致红细胞胞浆的主要成分血红蛋白合成障碍，胞浆发育迟缓，而胞核发育相对正常，表现为“核老浆幼”；巨幼红细胞性贫血（P544）（A错）由于叶酸或维生素B₁₂缺乏，导致DNA合成障碍，而RNA合成所受影响不大，细胞内RNA/DNA比值增大，造成细胞体积增大，胞核发育滞后于胞质，形成巨幼变及“核幼浆老”现象。急性红血病（B错）是一种骨髓内有核红细胞异常增生的恶性疾病，骨髓中异常的原始细胞及幼红细胞大量增殖并抑制正常造血，红细胞发育成熟障碍；骨髓增生异常综合征（P564）（D错）是一种起源于造血干细胞，以血细胞病态造血，高风险向急性髓系白血病（AML）转化为特征的难治性血细胞质、量异常的异质性疾病，骨髓象可见有核红细胞多核、核多分叶、巨幼样变；再生障碍性贫血（P547）（E错）是一种由不同病因和机制引起的骨髓造血功能衰竭，表现为正常细胞性贫血，仅有血细胞数量的减少。